下列哪项不是时行感冒的特征
A. 传染性强
B. 证候相似
C. 集中发病
D. 老幼易感
E. 流行性强

正确答案：D。老幼易感

解析：普通感冒病情较轻，全身症状不重，少有传变。四时气候变化时发病率可升高，但无明显流行性特点。若感冒1周以上不愈，发热不退，或反见加重，应考虑继发他病，传变入里。而时行感冒病情较重，发病急，全身症状显著，具有广泛的传染性、流行性，可以发生传变，化热入里，继发或合并他病。时行感冒可见于任何年龄（D错，为本题正确答案）。